O₂在血液中主要是和哪种蛋白结合来运输的
A. 血浆蛋白
B. 清蛋白
C. 肌红蛋白
D. 血红蛋白
E. 纤维蛋白

正确答案：D。血红蛋白